使用下列哪种酸进行釉质酸蚀后，釉质粘结作用最好
A. 醋酸
B. 盐酸
C. 硫酸
D. 草酸
E. 磷酸

正确答案：E。磷酸

解析：对釉质的粘接是通过用酸蚀刻的方法使釉质表面脱矿，提供一个适宜的粘接界面。用磷酸进行酸蚀刻的效果最优，脱矿均匀，出现的粗糙面润湿性和极化性好。掌握“树脂粘结概念及釉质、牙本质粘结”知识点。